可作为根除幽门螺旋杆菌感染一线治疗方案的是
A. 埃索美拉唑20mgbid+克拉霉素500mgqd+阿莫西林0.5gtid
B. 埃索美拉唑20mgbid+克拉霉素500mgtid+枸橼酸铋钾0.6gtid
C. 埃索美拉唑20mgqd+阿莫西林1.0gqd+枸橼酸铋钾0.6gqd
D. 埃索美拉唑20mgbid+克拉霉素500mgbid+阿莫西林1.0gbid+枸橼酸铋钾0.6gbid
E. 埃索美拉唑20mgtid+克拉霉素500mgqd+阿莫西林1.5gtid+枸橼酸铋钾0.6gtid

正确答案：D。埃索美拉唑20mgbid+克拉霉素500mgbid+阿莫西林1.0gbid+枸橼酸铋钾0.6gbid

解析：本题考查根除幽门螺旋杆菌感染一线治疗方案。根除幽门螺旋杆菌感染一线治疗方案主要有两种：质子泵抑制剂（PPI）（bid）+克拉霉素（bid）+阿莫西林（bid）+铋剂（bid）；PPI（bid）+克拉霉素（bid）+甲硝唑（bid）+铋剂（bid）。埃索美拉唑为PPI（质子泵抑制剂）中的一种，枸橼酸铋钾属于铋剂，所以埃索美拉唑20mgbid+克拉霉素500mgbid+阿莫西林1.0gbid+枸橼酸铋钾0.6gbid（D对）可作为根除幽门螺旋杆菌感染一线治疗方案。一线治疗方案里的每联用法均为一天两次（bid），所以qd（ACE错）、tid（B错）用法错误。